硬脑膜窦损伤易导致颅内血肿的原因
A. 内含有静脉血
B. 压力高
C. 窦壁血管特别丰富
D. 窦壁无平滑肌
E. 无瓣膜

正确答案：D。窦壁无平滑肌

解析：硬脑膜窦壁无平滑肌（D对），不能收缩，故损伤出血时难以止血，容易形成颅内血肿。